对水源选择进行环境卫生监督属
A. 经常性卫生监督
B. 预防性卫生监督
C. 环境监督
D. 环境监测
E. 环境调查

正确答案：B。预防性卫生监督

解析：本题考查水源的预防性卫生监督。对水源选择进行环境卫生监督属预防性卫生监督（B对ACDE错）。其目的是在水源选择过程中，采取有效措施，防止水源受到污染，以确保水源的安全性和卫生质量。